戒烟的临床干预可以使用何种方案进行简短干预
A. 5A方案
B. 5R方案
C. 5S方案
D. 5C方案
E. 5W方案

正确答案：A。5A方案

解析：临床干预可以使用5A方案进行简短干预。5A戒烟法是由5种活动所组成，每一个都由字母“A”开始，即：Ask询问所有患者关于吸烟的问题；Advise建议吸烟者戒烟；Assess评估吸烟者的戒烟意愿；Assist提供戒烟药物或者行为咨询治疗等：Arrange安排随访。掌握“干预基本模式及烟草行为干预”知识点。